某男，30岁。已婚3年，未育，来院就诊，检查结果显示精子存活率低，患者平日阳事不兴，伴小腹急满，小便短赤；舌苔薄黄，脉弦滑，宜选用的基础方剂是
A. 柴胡疏肝散
B. 大补元煎
C. 小蓟饮子
D. 程氏萆薢分清饮
E. 启阳娱心丹

正确答案：D。程氏萆薢分清饮

解析：本题考查的是男性不育症的辨证论治。已婚3年，未育，来院就诊，检查结果显示精子存活率低，患者平日阳事不兴，伴小腹急满，小便短赤；舌苔薄黄，脉弦滑，宜选用的基础方剂是程氏萆薢分清饮（D对）。男性不育症是指育龄夫妇同居一年以上，性生活正常，未采取任何避孕措施，女方有受孕能力，由于男方原因而致女方不能怀孕的一类疾病。西医学中不育症表现为上述症状者，可参考此内容辨证论治。（一）肾虚精亏证：【症状】阳痿不举，或性交时无力射出精液，或精热黏稠不化，或精子稀少、活力下降；伴腰膝酸软，耳鸣耳聋，健忘恍惚，发脱齿摇。舌质淡，脉细弱。【方剂应用】基础方剂为大补元煎（B错）（人参、炒山药、熟地、杜仲、枸杞、当归、山茱萸、炙甘草）合五子衍宗丸（枸杞子、菟丝子、覆盆子、五味子、车前子）加减。若阳虚症状较甚者，以金匮肾气丸（熟地黄、山药、山茱萸、茯苓、牡丹皮、泽泻、肉桂、附子）合五子衍宗丸加减。若阴虚症状较重者，以左归丸（熟地黄、山药、枸杞、山茱萸、川牛膝、菟丝子、鹿角胶、龟板胶）合五子衍宗丸加减。（二）肝郁气滞证：【症状】性欲低下，阳痿不举，或性交时不能射精，精子活力下降；伴心情抑郁，胸胁胀痛。舌淡红，苔薄，脉弦。【方剂应用】基础方剂为柴胡疏肝散（A错）（柴胡、川芎、香附、枳壳、芍药、陈皮、甘草）加减。（三）湿热下注证：【症状】阳事不兴或勃起不坚，精子少或死精较多；伴小腹急满，小便短赤。舌苔薄黄，脉弦滑。【方剂应用】基础方剂为程氏萆薢分清饮（萆薢、黄柏、石菖蒲、茯苓、白术、莲子心、丹参、车前子）加减。小蓟饮子（C错）为淋证血淋的方剂应用。淋证血淋：【症状】小便热涩刺痛，尿色深红，或夹有血块，疼痛满急加剧，或见心烦。舌尖红，舌苔黄，脉滑数。【方剂应用】基础方剂为小蓟饮子（小蓟、生地黄、滑石、木通、蒲黄、藕节、淡竹叶、当归、山栀子、甘草）加减。阳痿惊恐伤肾证：【症状】阳痿不振，伴心悸易惊，胆怯多疑，夜多噩梦，常有被惊吓史。舌苔薄白，脉弦细。【方剂应用】基础方剂为启阳娱心丹（人参、远志、茯神、石菖蒲、甘草、橘红、砂仁、柴胡、菟丝子、白术、酸枣仁、当归、白芍、山药、神曲）加减。